氯丙嗪治疗精神分裂症的作用机制是
A. 阻断黑质-纹状体的DA受体
B. 激动中脑-皮层和中脑-边缘系统的DA受体
C. 激动中脑-皮层和中脑-边缘系统的受体
D. 阻断中脑-皮层和中脑-边缘系统的M受体
E. 阻断中脑-皮层和中脑-边缘系统的D₂受体

正确答案：E。阻断中脑-皮层和中脑-边缘系统的D₂受体